男性，68岁。肝右叶巨大肿瘤，腹水征阳性。血清生化检查：白蛋白20g/L，总胆红素60μmol/L。血管造影示：门静脉右支闭塞。最适合的治疗方法为
A. 扩大肝右叶切除术
B. 肝动脉结扎术
C. 全身化疗
D. 肝动脉内抗癌药持续注入法
E. 放射疗法

正确答案：D。肝动脉内抗癌药持续注入法

解析：患者肝肿瘤，有腹水，白蛋白20g/L（低蛋白血症，低于正常值30g/L），总胆红素为60μmol/L（黄疸，大于正常值34.2μmol/L），门静脉右支闭塞（癌栓阻塞）。最适合的治疗方法是肝动脉内抗癌药持续注入法（D对）。扩大肝右叶切除术（A错）、肝动脉结扎术（B错）、全身化疗（C错）、放射疗法（E错）均不适用于合并黄疸、腹水的患者。